符合工效学要求的工间休息应该是
A. 时间足够长的休息
B. 次数足够多的休息
C. 多次、短时间的休息
D. 少次、长时间的休息
E. 随机无规律的休息

正确答案：C。多次、短时间的休息